在一种高分子囊材溶液中加入凝聚剂以降低囊材溶解度而凝聚成微囊的方法是
A. 界面缩聚法
B. 辐射交联法
C. 喷雾干燥法
D. 液中干燥法
E. 单凝聚法

正确答案：E。单凝聚法